某医院发生一起重大医疗过失行为，造成患者冯某死亡，鉴定为一级医疗事故冯父冯妻冯妹及堂兄表弟等6人从外地赶来参加了医疗事故的处理根据《医疗事故处理条例》规定，医院对参加事故处理的患者近亲属交通费误工费和住宿费的损失赔偿人数不超过
A. 二人
B. 三人
C. 四人
D. 五人
E. 六人

正确答案：A。二人

解析：参加医疗事故处理的患者近亲属所需交通费、误工费、住宿费，参照有关规定计算，计算费用的人数不超过2人。医疗事故造成患者死亡的，参加丧葬活动的患者的配偶和直系亲属所需交通费、误工费、住宿费，参照本条例第五十条的有关规定计算，计算费用的人数不超过2人（A对）。